根据疫苗流通和预防接种过，关于第二类疫苗流通管理的说法正确的是
A. 经审核批准药品批发企业可以经营并配送第二类疫苗
B. 由县级疾病预防控制机构，通过公共资源平台，向生产企业采，采购后供应本行政区域的接种单位
C. 疫苗生产企业直接向县级疾病预防控制机构配送及二类疫苗，不得委托配送
D. 县级疾病预防控制，接种单位供应第二类疫苗可以收取，收取疫苗费用，但不可以收取，存储运输费用

正确答案：B。由县级疾病预防控制机构，通过公共资源平台，向生产企业采，采购后供应本行政区域的接种单位

解析：本题考查第二类疫苗流通。根据疫苗流通和预防接种过，关于第二类疫苗流通管理的说法正确的是由县级疾病预防控制机构，通过公共资源平台，向生产企业采，采购后供应本行政区域的接种单位（B对）。《疫苗流通和预防接种管理条例》第二章疫苗流通第十五条第二类疫苗由省级疾病预防控制机构组织在省级公共资源交易平台集中采购，由县级疾病预防控制机构向疫苗生产企业采购后供应给本行政区域的接种单位。疫苗生产企业应当直接向县级疾病预防控制机构配送第二类疫苗（A错），或者委托具备冷链储存、运输条件的企业配送（C错）。接受委托配送第二类疫苗的企业不得委托配送。县级疾病预防控制机构向接种单位供应第二类疫苗可以收取疫苗费用以及储存、运输费用。疫苗费用按照采购价格收取，储存、运输费用按照省、自治区、直辖市的规定收取（D错）。收费情况应当向社会公开。